可作为片剂润滑剂的是
A. 硬脂酸镁
B. 羧甲基淀粉钠
C. 乙基纤维素
D. 羧甲基纤维素钠
E. 硫酸钙

正确答案：A。硬脂酸镁

解析：本题考查片剂的常用辅料。硬脂酸镁（MS）（A对）为片剂常用的润滑剂。广义的润滑剂按作用可以分为三类：助流剂、抗黏剂和狭义的润滑剂。常用的润滑剂（广义）有硬脂酸镁、微粉硅胶、滑石粉、氢化植物油、聚乙二醇类等。羧甲基淀粉钠（B错）为片剂常用的崩解剂；乙基纤维素（C错）、羧甲基纤维素钠（D错）均为片剂常用的黏合剂；硫酸钙（E错）为片剂常用的稀释剂。